不属于副交感神经核的有
A. 孤束核
B. 上泌涎核
C. 动眼神经副核
D. 迷走神经背核
E. 黑质

正确答案：A。孤束核

解析：副交感神经核的有动眼神经副核（C对）、上泌涎核（B对）、下泌涎核和迷走神经背核（D对），黑质（E对）属于脑内的副交感核；而孤束核（A错，为本题正确答案）属于一般内脏和特殊内脏感觉核。